白血病的牙龈病损时不可能出现的是
A. 牙龈肿胀常为局部性
B. 组织松软脆弱或中等硬度，表面光亮
C. 颜色暗红发绀或苍白
D. 牙龈炎症明显
E. 牙龈肿胀可覆盖部分牙面

正确答案：A。牙龈肿胀常为局部性

解析：本题考查白血病龈病损。白血病的牙龈病损：牙龈肿大，颜色暗红发绀或苍白（C对），组织松软脆弱或中等硬度，表面光亮（B对）。牙龈肿胀常为全口性（A错，为本题正确答案），且可覆盖部分牙面（E对）。由于牙龈肿胀、菌斑堆积，牙龈一般有明显的炎症（D对）。